有关硫脲类临床应用错误的是
A. 用于轻症和不宜手术的甲亢治疗
B. 用于甲状腺次全切除手术病人术前准备
C. 甲状腺危象的治疗
D. 用于甲状腺次全切除手术病人术前准备，应与碘剂配合使用
E. 用于甲状腺危象治疗时不能使用碘剂

正确答案：E。用于甲状腺危象治疗时不能使用碘剂